下列哪个间隙感染扩散不会引起颞间隙感染
A. 咬肌间隙
B. 下颌下间隙感染
C. 颊间隙感染
D. 颞下间隙
E. 翼下颌间隙

正确答案：B。下颌下间隙感染

解析：颞间隙的感染来源：常由咬肌间隙、翼下颌间隙、颞下间隙和颊间隙感染扩散引起。耳源性感染（化脓性中耳炎、颞乳突炎）、颞部疖痈以及颞部损伤继发感染均可波及颞间隙。掌握“颞间隙、咽旁间隙感染”知识点。